免疫球蛋白的功能区Ig通过折叠可形成若干球形结构域，这些结构域是
A. Ig的拮抗区
B. Ig的协同区
C. Ig的功能区
D. Ig的结合区
E. Ig的非功能区

正确答案：C。Ig的功能区

解析：免疫球蛋白的功能区：Ig通过折叠可形成若干球形结构域，这些结构域是Ig的功能区。掌握“免疫球蛋白基本概念及结构”知识点。